肺炎喘嗽脾肺气虚证的用方是
A. 人参五味子汤
B. 沙参麦冬汤
C. 小青龙汤
D. 麻杏石甘汤
E. 大青龙汤

正确答案：A。人参五味子汤

解析：肺炎喘嗽脾肺气虚证的用方是人参五味子汤，脾肺气虚证见于肺炎后期，病程迁延。临床以咳嗽无力，动辄汗出，面白少华为特征。治法为补肺健脾，益气化痰。选方人参五味子汤加减（A对）。肺炎喘嗽阴虚肺热证的治疗首选方剂是沙参麦冬汤（B错）。小青龙汤主治外寒里饮证（C错）。麻杏石甘汤主治外感风邪，邪热壅肺证（D错）。大青龙汤主治外感风寒，兼有里热，恶寒发热，身疼痛，无汗烦躁，脉浮紧（E错）。